两段式两次法种植术第1次和第2次手术间隔时间为
A. 1个月
B. 2个月
C. 2～3个月
D. 3～4个月
E. 7～9个月

正确答案：D。3～4个月

解析：本题考查两段式两次法种植术第1次和第2次手术的间隔时间。两段式两次法种植术分两期手术进行，第1次和第2次手术间隔时间为3～4个月（D对），上颌4个月，下颌3个月，待种植体与颌骨完成骨结合后，才能行二期手术，否则会导致种植修复的失败。